女，28岁。烦渴多尿1年，不规律用胰岛素治疗，恶心、呕吐3天。查体：体温36.2℃，呼吸深大，有烂苹果味。血糖22mmol/L，尿糖（﹢﹢﹢﹢），尿酮体（﹢﹢﹢）。最可能的诊断为
A. 急性胃肠炎
B. 代谢性碱中毒
C. 乳酸酸中毒
D. 糖尿病酮症酸中毒
E. 高渗高血糖综合征

正确答案：D。糖尿病酮症酸中毒